下列哪种化学物可产生光化学烟雾
A. 一氧化碳
B. 二氧化硫
C. 氮氧化物
D. 甲烷
E. 氯化物

正确答案：C。氮氧化物

解析：本题考查可产生光化学烟雾的化学物。光化学型烟雾是由汽车尾气中的氮氧化物（NOx）（C对ABDE错）和挥发性有机物（VOC）在日光紫外线的照射下，经过一系列的光化学反应生成的刺激性很强的浅蓝色烟雾。